男性，55岁。慢性支气管炎史5年，近1年咳痰血3次，鉴别诊断时哪项疾病不需要鉴别
A. 肺结核
B. 肺炎
C. 支气管扩张
D. 支气管肺癌
E. 支气管哮喘

正确答案：E。支气管哮喘